进行大气污染的健康影响调查时，能更确切反映空气污染物对机体实际暴露的观察指标是
A. 设点监测日平均浓度
B. 设点监测月平均浓度
C. 设点监测年平均浓度
D. 个体采样计算日平均浓度
E. 生物材料计算暴露量

正确答案：E。生物材料计算暴露量

解析：本题考查反映空气污染物对机体实际暴露的观察指标。进行大气污染的健康影响调查时，能更确切反映空气污染物对机体实际暴露的观察指标是生物材料计算暴露量（E对ABCD错）。